关于氢氯噻嗪临床应用的说法，错误的是
A. 与磺胺类药物存在交叉过敏反应
B. 老年患者服药后易发生低血压及肾功能损害
C. 服药期间应关注有无肌痉挛、耳鸣、听力障碍等症状
D. 对血糖和尿酸无影响，可长期服用
E. 服药期间应定期复查电解质水平

正确答案：D。对血糖和尿酸无影响，可长期服用

解析：本题考查氢氯噻嗪的临床应用。大剂量噻嗪类及噻嗪类似物有可能引起胰岛素抵抗、高血糖症，加重糖尿病及减弱口服降糖药的效能，引起血钾降低、血钙升高，血尿素氮、肌酐及尿酸升高（D错，为本题正确答案）。氢氯噻嗪与磺胺类药物存在交叉过敏反应（A对），老年患者服药后易发生低血压及肾功能损害（B对），服药期间应关注有无肌痉挛、耳鸣、听力障碍等症状（C对），服药期间应定期复查电解质水平（E对）。